直接参与葡萄糖合成糖原的核苷酸是
A. UTP
B. TTP
C. GTP
D. ADP
E. CTP

正确答案：A。UTP

解析：糖原合成起始于糖酵解的中间产物葡糖-6-磷酸。首先，葡糖-6-磷酸变构生成葡糖-1-磷酸。后者再与尿苷三磷酸（UTP）反应生成尿甘二磷酸葡萄糖（UDPG）和焦磷酸。UDPG可看作”活性葡萄糖”，在体内充当葡萄糖供体。因此直接参与葡萄糖合成糖原的核苷酸是UTP（A对）。